对于一组服从双变量正态分布的资料，经直线相关分析得相关系数r＝0.9，对该资料拟合回归直线，则其回归系数b值
A. b＞0
B. b＝0
C. b＜0
D. b＝1
E. 不能确定正负

正确答案：A。b＞0